患者，男，30岁。有糖尿病史。口渴多尿，多食易饥，形体消痩，大便干燥，舌红苔黄，脉滑实有力。其中医治法是
A. 活血化瘀祛痰
B. 益气健脾，生津止渴
C. 清胃泻火，养阴增液
D. 滋阴温阳，补肾固摄
E. 活血通络

正确答案：C。清胃泻火，养阴增液

解析：火盛伤阴，则口渴；胃火炽盛，腐熟水谷力强，故见多食易饥；阳明热盛，耗伤津血，无以充养肌肉，则形体消痩；胃津不足，不能濡润大肠则大便干燥；舌红苔黄，脉滑实有力属于胃火炽盛之象，其治法是清胃泻火，养阴增液（C对）。活血化瘀祛痰（A错）用于痰瘀互结证。益气健脾，生津止渴（B错）用于气阴两虚证。滋阴温阳，补肾固摄（D错）用于阴阳两虚证。活血通络（E错）用于脉络瘀阻证。